横切面显强粉性，气微，味淡而微酸，嚼之发黏的药材是
A. 前胡
B. 山药
C. 天花粉
D. 葛根
E. 茯苓

正确答案：B。山药

解析：本题考查的是山药药材的性状鉴别。横切面显强粉性，气微，味淡而微酸，嚼之发黏的药材是山药（B对）。山药：【性状鉴别】药材毛山药略呈圆柱形，弯曲而稍扁。表面黄白色或淡黄色，有纵沟、纵皱纹及须根痕，偶有浅棕色的外皮残留。体重，质坚实，不易折断，断面白色，粉性。气微，味淡，微酸，嚼之发黏。天花粉（C错）：【性状鉴别】药材呈不规则圆柱形、纺锤形或瓣块状。表面黄白色或淡棕黄色，有纵皱纹、细根痕及略凹陷的横长的皮孔；有的有黄棕色外皮残留。质坚实，断面白色或淡黄白色，富粉性，横切面可见黄色小孔（导管），略呈放射状排列，纵切面可见黄色条纹状木质部。气微，味微苦。葛根（D错）：【性状鉴别】药材呈纵切的长方形厚片或小方块。外皮淡棕色至棕色，有纵皱纹，粗糙。切面黄白色至淡黄棕色，有的纹理不明显。质韧，纤维性强。气微，味微甜。茯苓（E错）：【性状鉴别】药材茯苓个呈类球形、椭圆形、扁圆形或不规则团块，大小不一。外皮薄而粗糙，棕褐色至黑褐色，有明显的皱缩纹理。体重，质坚实，断面颗粒性，有的具裂隙，外层淡棕色，内部白色，少数淡红色，有的中间抱有松根（习称茯神）。气微，味淡，嚼之粘牙。前胡（A错）药材的性状鉴别，2022年考试指南未明确说明。